越鞠丸中行气解郁的药物是
A. 木香
B. 沉香
C. 香附
D. 枳壳
E. 厚朴

正确答案：C。香附

解析：本题考查越鞠丸的方解。越鞠丸证由肝脾气机郁滞，以致气、血、火、湿、痰、食相因成郁，以气郁为先。人以气为本，气和则病无由生，若喜怒无常，忧思过度，或饮食失节，寒温不适等，均可引起气机郁滞。肝气郁结，气机不畅，则胸膈痞闷胀痛；气郁日久势必及血，而致血郁，则胁腹刺痛而有定处；郁久化火，则病火郁，则吞酸嘈杂；肝郁乘脾，运化失司，脾不胜湿则湿郁；湿聚生痰则痰郁，暖气呕恶；水谷不运，则饮食不消为食郁。气、血、火郁责之于肝，湿、痰、食郁责之于脾，由此可见，六郁之病主要在肝脾郁滞，尤以气郁为主。其治法，重在行气解郁，使气行则血行，气顺则火、湿、痰、食诸郁皆消。方中香附行气舒肝开郁，以治气郁，为君药。川芎为血中之气药，既助君药行气开郁，又可活血祛瘀，以治血郁；苍术燥湿健脾，以治湿郁；神曲消食和胃，以治食郁；栀子清热泻火，以治火郁，共为臣佐药。本方五药，理气为先，统治六郁证（C对）。木香、沉香、枳壳、厚朴均不是越鞠丸的组成药物（ABDE错）。